医务人员遵从临终患者和家属的请求，给予减轻痛苦的维持治疗，直至生命自行终止。这种做法属于
A. 积极安乐死
B. 终止治疗
C. 医助自杀
D. 消极安乐死
E. 主动安乐死

正确答案：D。消极安乐死

解析：医务人员经患者或患者家属的请求，不再给与积极治疗，撤除患者赖以维持生命的体外循环装置、人工呼吸装置及其他辅助设施，给予减轻痛苦的适当维持治疗，任其等待死亡的降临，自然逝去（D对）称为安乐死。主动安乐死：亦称积极安乐死，指患者治愈无望，痛苦难耐，应患者或家属的请求，医务人员采用药物或其他主动的手段促进患者生命的结束，让其安然死亡（AE错）。